土炒当归的炮制作用是
A. 增强活血调经作用
B. 增强滑润作用
C. 增强补血止血作用
D. 增强破血作用
E. 既增强补血作用，又缓和滑润作用

正确答案：E。既增强补血作用，又缓和滑润作用

解析：本题考查的是当归的炮制作用。土炒当归的炮制作用是既增强补血作用，又缓和滑润作用（E对）。当归：【炮制作用】当归味甘、辛、性温。归肝、心、脾经。①生品质润，具有补血，调经，润肠通便（B错）的功能。传统习惯止血用当归头，补血用归身，破血（D错）用当归尾，补血活血用全当归。当归生用还可用于血虚萎黄，眩晕心悸，月经不调，肠燥便秘，痈疽疮疡。②酒炙当归，增强活血通经（A错）、祛瘀止痛的作用。用于经闭痛经，风湿痹痛，跌打损伤，瘀血肿痛。③土炒当归，既能增强入脾补血作用，又能缓和油润而不滑肠。可用于治疗血虚便溏，腹中时痛。④当归炭，具有止血和血（C错）作用。用于崩中漏下，月经过多。